在体内与二价金属离子，与Mg²⁺结合，产生抗结核作用的药物是
A. 异烟肼
B. 异烟腙
C. 盐酸乙胺丁醇
D. 对氨基水杨酸钠
E. 吡嗪酰胺

正确答案：C。盐酸乙胺丁醇

解析：本题考查盐酸乙胺丁醇。盐酸乙胺丁醇（C对）在体内可以与二价离子Mg²⁺结合，以此干扰RNA的合成，从而产生抗结核杆菌的作用。对繁殖期的结核杆菌和其它分支杆菌的抑制作用强大，但是对于其它的微生物几乎没有作用，且只对生长繁殖期细菌有效，对静止期细菌几乎无效。异烟肼（A错）为酰肼类化合物，在肝内代谢为乙酰异烟肼和异烟酸等，但代谢产物无活性。异烟腙（B错）为异烟肼衍生物，其作用机理与异烟肼相似。对氨基水杨酸（D错）结构与对氨基苯甲酸相似，可竞争性抑制二氢叶酸合成酶，使二氢叶酸合成障碍产生抗结核作用，水解后失活。在体内被水解成羧酸，抑制结核杆菌生长的药物是吡嗪酰胺（E错）。因为吡嗪酰胺是人工合成的烟酰胺类似物，可被巨噬细胞或单核细胞摄取，在细胞内酸性环境中对缓慢繁殖菌发挥抗菌活性，药物可被分支杆菌的吡嗪酰胺酶代谢为具有抗菌活性的吡嗪酸。